对受体亲和力较强、结合牢固，缺乏内在活性的（α=0）药物属于
A. 完全激动药
B. 部分激动药
C. 竞争性拮抗药
D. 非竞争性拮抗药
E. 反向激动药

正确答案：D。非竞争性拮抗药

解析：本题考查作用于受体药物的分类。对受体亲和力较强、结合牢固，缺乏内在活性的（α=0）药物属于非竞争性拮抗药（D对）。非竞争性拮抗剂通过共价键作用于受体结合牢固，呈不可逆性，妨碍激动剂与特异性受体结合。完全激动药（A错）有很大的亲和力和内在活性（α=1），能与受体结合并产生最大效应。部分激动药（B错）具有较强亲和力，但内在活性低（α＜1），与受体结合后只能产生较弱的效应。竞争性拮抗药（C错）与受体有很高亲和力，但缺乏内在活性（α=0），与激动药合用，在增强激动药的剂量或浓度时，激动药的量-效曲线平行右移，但最大效应不变。反向激动药（E错）是指有些药物（如苯二氮䓬类）对失活状态的受体亲和力大于活化状态，药物与受体结合后引起与激动药相反的效应。